患严重急性胰腺炎的病人不能使用
A. 抗生素
B. 吗啡
C. 液体治疗
D. 氯化钠
E. 钙

正确答案：B。吗啡